以下哪项不是小儿的生理特点
A. 脏腑娇嫩
B. 发育迅速
C. 形气未充
D. 肝常有余
E. 生机蓬勃

正确答案：D。肝常有余

解析：小儿的生理特点包括脏腑娇嫩（A对）、形气未充（C对）和生机蓬勃（E对），发育迅速（B对）。脏腑娇嫩、形气未充，是说小儿时期机体各系统和器官的形态发育都未曾成熟，生理功能都是不完善的。生机蓬勃，发育迅速，指的是小儿充满生机，在生长发育过程中，无论在机体的形态结构方面，还是各种生理功能活动方面，都是在不断地、迅速地向着成熟、完善方向发展。肝常有余为小儿的病理特点之一（D对，为本题正确答案）。